停药或者突然减少药物用量引起的不良反应是
A. A型反应（扩大反应）
B. D型反应（给药反应）
C. E型反应（撤药反应）
D. F型反应（家族反应）
E. G型反应（基因毒性）

正确答案：C。E型反应（撤药反应）

解析：本题考查药品不良反应。停药或者突然减少药物用量引起的不良反应是E型反应（撤药反应）（C对）。E型反应（撤药反应）是指停止给药或剂量突然减小后发生的不良发应。大多与给药时程有关，而不是与剂量有关。A型反应（A错）是药物对人体呈剂量相关的反应，它是不良反应中最常见的类型。D型反应（给药反应）（B错）是由药物特定的给药方式引起的不良发应。如植入药物周围的炎症或纤维化、注射液中微粒引起的血栓形成或血管栓塞等。F型反应（家族反应）（D错）是由家族性遗传疾病引起的不良发应。G型反应（E错）即药物损伤基因、出现致癌、致畸等不良反应。